辅助诊断伤寒或副伤寒的血清学试验名称为
A. ELISA法
B. 中和试验
C. 试管凝集试验
D. 放射免疫法
E. 蛋白印迹试验

正确答案：C。试管凝集试验

解析：肥达试验是辅助诊断伤寒或副伤寒的血清学试验，又称试管凝集试验。（扩展内容）掌握“细菌学、血清学诊断及感染防治”知识点。